关于氟牙症与牙釉质发育不全鉴别点哪项是错误的
A. 氟牙症好发于恒牙，牙釉质发育不全乳牙和恒牙都易发生
B. 牙釉质发育不全白垩色斑边界比较明确，而氟牙症不明确
C. 牙釉质发育不全可发生于单个牙或一组牙，而氟牙症好发于多数牙
D. 氟牙症患者可有在高氟区的生活史
E. 牙釉质发育不全白垩色线纹与釉质生长发育线相平行吻合，而氟牙症不相吻合

正确答案：A。氟牙症好发于恒牙，牙釉质发育不全乳牙和恒牙都易发生

解析：本题考查氟牙症与牙釉质发育不全的鉴别。氟斑牙和釉质发育不全均好发于恒牙（A错，为本题的正确答案）。牙釉质发育不全白垩色斑边界比较明确，而氟牙症不明确（B对）。牙釉质发育不全可发生于单个牙或一组牙，而氟牙症好发于多数牙（C对）。氟牙症患者可有在高氟区的生活史，而釉质发育不全无高氟区生活史（D对）。牙釉质发育不全白垩色线纹与釉质生长发育线相平行吻合，而氟牙症不相吻合（E对）。